甲苯进入体内后，从尿中排出的代谢产物主要是
A. 甲酚
B. 苯甲醇
C. 对苯酚
D. 对氨基酚
E. 马尿酸

正确答案：E。马尿酸